一名耕种水稻的农民，突然出现高热、乏力，伴有腓肠肌疼痛和眼结膜出血、以及淋巴结肿大，进而出现黄疸。该患者可能是哪种微生物感染
A. 霍乱弧菌
B. 钩端螺旋体
C. 梅毒螺旋体
D. 甲型肝炎病毒
E. 伯氏疏螺旋体

正确答案：B。钩端螺旋体

解析：由于钩端螺旋体水中长期存活及其疾病自然疫源性的特点，钩端螺旋体病史我国洪涝、地震等自然灾害中重点监控的四种传染病之一。根据流行特征可分为稻田型、雨水型和洪水型。掌握“概述及梅毒螺旋体”知识点。